在牙髓病中，X线片检查有意义的是
A. 牙髓充血
B. 急性牙髓炎
C. 慢性牙髓炎
D. 牙髓坏死
E. 牙内吸收

正确答案：E。牙内吸收

解析：本题考查X线片检查。牙内吸收（E对）是指正常的牙髓组织肉芽性变，分化出破牙本质细胞从髓腔内部吸收牙体硬组织，致髓腔壁变薄，严重者可造成病理性牙折，X线片可显示髓腔内有局限性不规则的膨大透影区域，严重者可见内吸收处的髓腔壁被穿通，甚至出现牙根折断线。X线片的表现是牙内吸收的主要诊断依据。X线片检查是目前口腔医学临床应用最为普遍的检查方法之一，是利用X光的穿透作用以及不同组织吸收不同而摄取的浓淡不一的影像，常用于骨性硬组织的检查，而软组织在X光片上常不显影。牙体组织分为三种硬组织即牙骨质、牙本质、牙釉质，一种软组织即牙髓。牙髓病中，牙髓充血（A错），急性牙髓炎（B错），慢性牙髓炎（C错），牙髓坏死（D错）均为软组织出现病变，在X线片上常无显影，不具诊断意义。